下列主里虚证的脉象是
A. 数脉
B. 迟脉
C. 沉脉
D. 洪脉
E. 伏脉

正确答案：A。数脉

解析：数脉多见于热证亦主里虚证，心主血脉，实热内盛，气血受邪热鼓动而运行加速；心主血脉，主要依赖心气的推动，数脉可以出现气血不足的虚证（A对）。迟脉主寒证，亦见于邪热积聚（B错）。沉脉多主里证（C错）。洪脉主热盛（D错）。伏脉常见于邪闭、厥病和痛极的病人（E错）。